主动脉瓣中度狭窄时瓣口面积为
A. ＜0.75cm²
B. 0.75～1.0cm²
C. 1.1～1.75cm²
D. 1.76～2.0cm²
E. 2.1～4.0cm²

正确答案：C。1.1～1.75cm²

解析：九版内科学教材P296认为主动脉瓣中度狭窄时射流速度3～4m/s，平均压力阶差25～40mmHg，瓣口面积1.0～1.5cm²。因此本题最佳答案为1.1～1.75cm²（C对ABDE错）。七版内科学教材P315认为主动脉瓣中度狭窄瓣口面积0.75～1.0cm²。此题为老题，七、九版内科学数据有所不同，现在应以第九版教材为准。